患者，女，5岁，体重25kg。两天前受凉后发热，最高体温38.9℃，并伴有鼻塞、咳嗽、喷嚏、流鼻涕等感冒症状。家长到药店购买酚麻美敏口服溶液、小儿氨酚黄那敏颗粒、对乙酰氨基酚混悬滴剂和盐酸麻黄碱滴鼻液。药师应向家属做用药交代，儿童应用对乙酰氨基酚混悬滴剂的注意事项是
A. 每天用药最多不应超过6次，用药不超过3天
B. 每天用药最多不应超过5次，用药不超过3天
C. 每天用药最多不应超过4次，用药不超过3天
D. 每天用药最多不应超过3次，用药不超过7天
E. 每天用药最多不应超过2次，用药不超过7天

正确答案：C。每天用药最多不应超过4次，用药不超过3天

解析：本题考查儿童应用对乙酰氨基酚混悬滴剂的注意事项。药师应向家属做用药交代，儿童应用对乙酰氨基酚混悬滴剂的注意事项是每天用药最多不应超过4次，用药不超过3天（C对）。儿童按体重一次10～15mg/kg，每隔4～6小时重复用药1次，每24小时不多于4次。用药不超过3天。